具有趋下特性的六淫之邪为
A. 燥
B. 暑
C. 火
D. 湿
E. 寒

正确答案：D。湿

解析：本题考查的是六淫的性质及治病特点。湿具有趋下特性的六淫之邪为（D对）。在中医病因学中六淫是最主要的发病因素之一。六淫即风、寒、暑、湿、燥、火六种外感病邪的统称。六淫的性质及治病特点：1.风邪的性质及致病特点：（1）风为阳邪，其性开泄，易袭阳位；（2）风邪善行而数变；（3）风为百病之长。2.寒（E错）邪的性质及致病特点：（1）寒为阴邪，易伤阳气；（2）寒性凝滞，主痛；（3）寒性收引。3.暑（B错）邪的性质及致病特点：（1）暑为阳邪，其性炎热；（2）暑性升散，耗气伤津；（3）暑多挟湿。4.湿邪的性质及致病特点：（1）湿为阴邪，易阻遏气机，损伤阳气；（2）湿性重浊；（3）湿性黏滞；（4）湿性趋下，易伤阴位。5.燥（A错）邪的性质及致病特点：（1）燥性干涩，易伤津液；（2）燥易伤肺。6.火（C错）邪的性质及致病特点：（1）火热为阳邪，其性炎上；（2）火易伤津耗气；（3）火热易生风动血；（4）火热易发肿疡。